细胞化学染色变化为非特异性酯酶（＋），可被氟化钠抑制的疾病是
A. 急性巨核细胞白血病
B. 急性单核细胞白血病
C. 急性早幼粒细胞性白血病
D. 急性粒细胞白血病未分化型
E. 急性淋巴白血病

正确答案：B。急性单核细胞白血病

解析：细胞化学染色变化为非特异性酯酶（＋），可被氟化钠抑制≧50%的白血病类型是急性单核细胞白血病（B对）。细胞化学染色变化为非特异性酯酶（±），可被氟化钠抑制<50%的白血病类型是急性早幼粒细胞白血病（C错）。细胞化学染色变化为非特异性酯酶（—）的白血病类型为急性淋巴白血病（E错）。